乙型肝炎的潜伏期是
A. 1～2周
B. 2～6周
C. 4～8周
D. 6～8周
E. 8～10周

正确答案：E。8～10周

解析：不同类型病毒引起的肝炎潜伏期不同，甲型肝炎2～6周，平均4周（B错）；乙型肝炎1～6个月，平均3个月（E对）；丙型肝炎2周～6个月，平均40日；丁型肝炎4～20周；戊型肝炎2～9周，平均6周。